患者因受精神刺激而气逆喘息，面红目赤，呕血，继则昏厥卒倒。其病机是
A. 怒则气上
B. 悲则气消
C. 喜则气缓
D. 思则气结
E. 恐则气下

正确答案：A。怒则气上

解析：“患者因受精神刺激而气逆喘息，面红目赤，呕血，继则昏厥卒倒”符合怒则气上的临床表现。怒则气上：是指过怒导致肝气疏泄太过，气机上逆，甚则血随气逆，并走于上的病机变化。临床主要表现为：头胀头痛，面红目赤，呕血，甚则昏厥卒倒；若兼发肝气横逆，可兼见腹痛、腹泻等症（A对，BCDE错）。